研究某药物对某病的治疗效果时，试验对象应该是
A. 严重型病人
B. 男、女人数必须相等
C. 患病人群中有代表性的样本
D. 对照组为非患某病的人组成
E. 非典型症状的病人

正确答案：C。患病人群中有代表性的样本

解析：本题考查研究对象的选择。在进行实验研究时，应选择对干预措施有效的人群。如在现场试验中，应选择某病的易感人群为研究对象，要防止将病人或非易感者选入。在临床试验中，选择病例要有统一的、公认的诊断标准，而且最好利用客观的诊断指标，避免把未患病者选入而影响研究的真实效果。要注意研究对象的代表性（C对ABDE错），样本应具备总体的某些基本特征，其比例要能代表总体。